聚证患者，食滞痰阻，痰湿较重，服六磨汤后，腑气虽通，但症状未减，舌苔白腻而不化。治疗应首选
A. 二陈汤
B. 藿朴夏苓汤
C. 平胃散
D. 五苓散
E. 杏苏散

正确答案：C。平胃散

解析：聚证患者，食滞痰阻，痰湿较重，服六磨汤后，腑气虽通，但症状未减，舌苔白腻而不化，说明患者此时湿邪尚重，治疗应重在燥湿。平胃散功用健脾燥湿，为此时治疗的首选方（C对）。二陈汤功能燥湿化痰，理气和中，为治疗喘证之痰浊阻肺证的选方（A错）。藿朴夏苓汤功能宣通气机，燥湿利水，主治湿热病邪在气分而湿偏重者（B错）。五苓散功能通阳化气利水，常配合真武汤治疗肺胀阳虚水泛证（D错）。杏苏散功能清宣凉燥，理肺化痰，为治疗咳嗽风燥伤肺证选方（E错）。